有关锥体交叉的描述，正确的是
A. 位于延髓背侧下端
B. 交叉后纤维全部行于脊髓外侧索
C. 交叉后的纤维管理同侧上、下肢随意运动
D. 交叉后的纤维下行支配对侧躯体运动核团
E. 为皮质核束的纤维交叉

正确答案：B。交叉后纤维全部行于脊髓外侧索

解析：椎体交叉参与躯干和四肢意识性本体感觉的精细触觉的传导通路。该通路第2级神经元的胞体在薄、楔束核内，由此二核发出的纤维向前绕过中央灰质的腹侧，在中线上与对侧的交叉，形成丘系交叉（A错），交叉后的纤维管理对侧上、下肢随意运动（C错）。交叉后的纤维转折向上，在锥体束的背侧呈前后方向排列，全部行于脊髓外侧索（B对）。